人工喂养每日水的需要量是
A. 170ml/Kg
B. 150ml/Kg
C. 120ml/Kg
D. 100ml/Kg
E. 80ml/Kg

正确答案：B。150ml/Kg

解析：人工喂养每日水的需要量是150ml/Kg（B对）。按八版教材100ml/kg和150ml/kg都可以，老教材则只有150ml/Kg正确。